南京成立“中国心理卫生协会”于
A. 1916年
B. 1926年
C. 1936年
D. 1946年
E. 1956年

正确答案：C。1936年

解析：心理卫生运动迅速推广，于1930年5月5日在华盛顿成立了国际心理卫生委员会。其宗旨是“完全从事于慈善的、科学的、文艺的、教育的活动。尤其关心世界各国人民的心理健康的保持和增进对心理疾病、心理缺陷的研究、治疗和预防以及增进全世界人民的幸福。”中国也有代表参加，并于1936年4月在南京成立了“中国心理卫生协会”。后因日军侵华，活动停顿。掌握“心理健康概述”知识点。